为预防甲亢术后出现甲状腺危象，最关键的措施是
A. 术后用冬眠合剂镇静
B. 吸氧
C. 术后给予氢化可的松
D. 术后补钙
E. 术前使基础代谢率降至正常范围

正确答案：E。术前使基础代谢率降至正常范围

解析：甲亢病人在基础代谢率高亢的情况下进行手术容易发生甲状腺危象，术前使基础代谢率降至正常范围（E对）是预防甲亢术后出现甲状腺危象的最关键措施。术后用冬眠合剂镇静（A错）不是预防甲亢术后甲状腺危象的关键。冬眠合剂用于治疗甲状腺危象，能够缓解神经系统的兴奋性，减轻神经系统所受损伤，同时有一定的降低体温的效果。吸氧（B错）可提高单位组织的供量量，减轻甲危时处于高代谢状态的组织的缺氧程度。术后给予氢化可的松（C错）亦可用于治疗术后甲危，可抑制外周组织中T4转化为T3和T3与细胞受体结合，拮抗过多甲状腺素引起的全身反应。术后补钙（D错）可用于治疗甲状旁腺损伤所致低血钙性手足抽搐，并不能预防术后甲状腺危象。